由于心脏容量负荷过重导致心功能不全的是
A. 主动脉瓣关闭不全
B. 主动脉瓣狭窄
C. 高血压
D. 肺动脉高压
E. 心肌梗死

正确答案：A。主动脉瓣关闭不全

解析：心功能不全的病因可分为：心肌收缩性降低、心室负荷过重和心室舒张及充盈受限，心室负荷过重又可分为容量负荷过重和压力负荷过重。心肌梗死（E错）可引起心肌细胞发生变性、坏死，使心肌收缩性降低，导致心功能不全。主动脉瓣关闭不全（A对）时，舒张期主动脉内的血液可经关闭不全的主动脉瓣反流回左心室，增加了下一次泵血时左心室的容量负荷（心肌收缩前承受的负荷）。主动脉瓣狭窄（B错）、高血压（C错）、肺动脉高压（D错）均增加心室射血时要克服的阻力即压力负荷，而非容量负荷。